铁剂治疗缺铁性贫血有效的最早期指标是
A. 血清铁蛋白增高
B. 血红蛋白升高
C. 骨髓细胞外铁增多
D. 红细胞总数升高
E. 网织红细胞升高

正确答案：E。网织红细胞升高

解析：铁剂治疗缺铁性贫血有效的最早期指标是网织红细胞升高（E对），其次是血红蛋白、红细胞总数升高（BD错），骨髓细胞外铁（C错）、血清铁蛋白（A错）等贮存铁最后升高。